慢性增殖型念珠菌病的临床特征为
A. 口腔黏膜出现白色丘疹、交叉网状条纹，基底黏膜充血
B. 口腔黏膜上出现白色凝乳状斑点或斑膜，无明显自觉症状
C. 口腔黏膜可见边界清楚的红斑，舌乳头萎缩伴口角黏膜糜烂、皲裂
D. 口角内侧黏膜上出现致密白色斑块，表面粗糙，伴双侧口角发红及皲裂形成
E. 舌背中央后部黏膜出现菱形的丝状乳头萎缩区，表面可出现结节状增生，扪诊有坚硬感，但基底柔软

正确答案：D。口角内侧黏膜上出现致密白色斑块，表面粗糙，伴双侧口角发红及皲裂形成

解析：本题考查慢性增殖型念珠菌病的临床特征。慢性增殖型念珠菌病：又称慢性肥厚型念珠菌口炎、念珠菌白斑。多见于颊黏膜、舌背及腭部。病损为颊黏膜病损，常对称地位于口角内侧三角区，呈结节状或颗粒状增生，或为固着紧密的白色角质斑块（D对）。口腔黏膜出现白色丘疹、交叉网状条纹，基底黏膜充血（A错）为扁平苔藓的口腔临床特征。口腔黏膜上出现白色凝乳状斑点或斑膜，无明显自觉症状（B错）为白色角化症的临床特征。口腔黏膜可见边界清楚的红斑，舌乳头萎缩伴口角黏膜糜烂、皲裂（C错）为多形性红斑的临床特征。舌背中央后部黏膜出现菱形的丝状乳头萎缩区，表面可出现结节状增生，扪诊有坚硬感，但基底柔软（E错）为正中菱形舌炎的临床特征。